将总体按年龄分成若干年龄段，再在每个年龄段中随机抽取调查对象，再将每个年龄段所有抽取的调查对象合成一个样本，称为
A. 多级抽样
B. 整群抽样
C. 分层抽样
D. 系统抽样
E. 单纯随机抽样

正确答案：C。分层抽样

解析：本题考查抽样调查的方法。将总体按年龄分成若干年龄段，再在每个年龄段中随机抽取调查对象，再将每个年龄段所有抽取的调查对象合成一个样本，称为分层抽样（C对）。抽样调查的方法：1.分层抽样：先将总体按某种特征分成若干个“层”即组别或类型等，再在每个层中用随机方式抽取调查对象，再将每个层所有抽取的调查对象合成一个样本，称分层抽样。常用的分层因素有年龄、性别、居住地、文化程度、经济条件等。还可分成等比例（即按比例）和不等比例（即最优分配）两种分层随机抽样。2.单纯随机抽样（E错）：是最基本的抽样方法，也是其他抽样方法的基础。它是按一定方式以同等的概率抽样，称单纯随机抽样。可以使用抽签的方式，也可以使用随机数字表来抽取样本。3.系统抽样（D错）：又称间隔抽样、机械抽样。将抽样对象按次序编号，先随机抽取第一个调查对象，然后再按一定间隔随机抽样。4.整群抽样（B错）：是以整群为抽样单位，从总体中随机抽取若干群为调查单位，然后对每个群内所有对象进行检查。5.多级抽样（A错）：又称多阶段抽样。在进行大规模调查时，常把抽样过程分为几个阶段，每个阶段可采用单纯随机抽样，也可将以上各种方法结合起来使用。我国进行的四次口腔健康流行病学调查就是采用这种方法，称为分层、不等比（或等比）、多阶段和整群抽样法。